可能引起高铁血红蛋白血症的抗高血压药是
A. 阿利克仑
B. 氨氯地平
C. 卡托普利
D. 硝普钠
E. 甲基多巴

正确答案：D。硝普钠

解析：本题考查抗高血压药。可能引起高铁血红蛋白血症的抗高血压药是硝普钠（D对）。硝普钠代谢物可致毒性反应，发生高铁血红蛋白血症。阿利克仑（A错）为肾素抑制剂，可致严重低血压、皮疹、高钾血症等不良反应。氨氯地平（B错）为钙通道阻滞剂，可致脚踝肿胀。卡托普利（C错）为ACEI类药，可致高钾血症、持续性干咳等不良反应。甲基多巴（E错）可引起便秘、男性乳房增大等不良反应。